以碳酸氢钠和枸橼酸为崩解剂的片剂是
A. 糖衣片
B. 植入片
C. 薄膜衣片
D. 泡腾片
E. 口含片

正确答案：D。泡腾片

解析：本题考查泡腾片。泡腾片（D对）以碳酸氢钠和枸橼酸为崩解剂；糖衣片为片剂表面包的一层糖衣（A错）；植入片（B错）是指埋植到人体皮下缓缓溶解、吸收的片剂；薄膜衣片（C错）在片芯之外包一层薄的高分子聚合物衣，形成薄膜；口含片（E错）是指含于口腔中缓慢溶化产生局部或全身作用的片剂。